亚慢性毒性试验的期限是
A. 环境毒理学3～6个月
B. 食品毒理学3～6个月
C. 工业毒理学1～3个月
D. 食品毒理学90天喂养
E. 以上都对

正确答案：E。以上都对

解析：本题考查亚慢性毒性试验的期限。亚慢性毒性试验的期限是：环境毒理学3～6个月；食品毒理学3～6个月；工业毒理学1～3个月；食品毒理学90天喂养（E对ABCD错）。